小儿上呼吸道感染常见夹滞的原因是
A. 肺常不足
B. 脾常不足
C. 肝常有余
D. 肾常虚
E. 肺脏娇嫩

正确答案：B。脾常不足

解析：小儿上呼吸道感染常见夹滞，出现脘腹胀满，不思乳食，或伴呕吐、泄泻等症，是由于小儿感邪之后，脾运失司，稍有饮食不节，致乳食停积，阻滞中焦所致，即脾常不足（B对）。肺常不足（A错）是小儿上呼吸道感染常见夹痰的原因。肝常有余（C错）为小儿病理特点之一，是小儿上呼吸道感染常见夹惊的原因。肾常虚（D错）是针对小儿“气血未充，肾气未固”而言，肾藏精，主骨，为先天之本，关系到小儿骨、脑、发、耳、齿的功能及形态，关乎生长发育和性功能成熟，可引起五软、遗尿等肾系疾病。肺脏娇嫩（E错）指肺脏发育未成熟，多表现为肺常不足。